颈部损伤一般不发生
A. 颈部血肿
B. 乳糜漏
C. 高位截瘫
D. 颈椎损伤
E. 气管移位

正确答案：B。乳糜漏

解析：本题考查颈部损伤。胸导管或淋巴管主要分支破损引起乳糜液溢出，即为乳糜漏。胸导管在第5胸椎以上破裂时，发生左侧乳糜胸；在第5胸椎以下破裂时，则出现右侧乳糜胸（B错，为本题的正确答案）。颈部伤易伴发颈部血肿（A对）、颈椎损伤（D对）或高位截瘫（C对），导致气管移位（E对）。